下面哪项属于学生用品卫生监督的内容
A. 学校食品卫生
B. 学生文具
C. 传染病防治
D. 学校饮用水卫生
E. 学校教室、办公用房的设计

正确答案：B。学生文具